地高辛与氢氯噻嗪合用治疗充血性心力衰竭，为预防强心苷中毒，尤其应警惕的是
A. 低血钠
B. 低血氯
C. 低血钾
D. 低血钙
E. 低血糖

正确答案：C。低血钾

解析：地高辛属于强心苷类正性肌力药，其安全范围窄，易发生强心苷中毒反应，因此识别强心苷的中毒先兆并及时停药，对于防止严重中毒反应的发生十分重要，通常低血K⁺、低血Mg²⁺、高血Ca²⁺、心肌缺氧和肾功能低下均是强心苷中毒的诱发因素，噻嗪对碳酸酐酶也有轻度抑制作用，使H⁺-Na⁺交换减少，Na⁺-K⁺交换增加，易引起低血钾症而诱发强心苷中毒，因此地高辛与氢氯噻嗪合用治疗充血性心力衰竭，应该警惕低血钾（C对）。低血钠（A错）、低血氯（B错）、低血糖（E错）均不是诱发强心苷中毒的因素。噻嗪类利尿药还能促进远曲小管由PTH调节的钙离子重吸收过程而减少尿钙的含量，减少钙离子在管腔中的沉积，这可能是由于钠离子重吸收减少，促进基侧质膜的钠钙交换所致，因此不引起低血钙（D错）。